以下关于咽旁间隙解剖特点的描述中，正确的是
A. 位于翼内肌、腮腺深叶与咽侧壁之间
B. 下至舌骨平面
C. 前界为翼下颌韧带
D. 后界为椎前筋膜外侧份
E. 以上均正确

正确答案：E。以上均正确

解析：咽旁间隙（咽侧间隙）位于翼内肌、腮腺深叶与咽侧壁之间。上达颅底，下至舌骨平面，前界为翼下颌韧带，后界为椎前筋膜外侧份。掌握“面侧深区及颌面部各间隙的境界”知识点。